属于非极性溶剂的是
A. 苯扎溴铵
B. 液状石蜡
C. 苯甲酸
D. 聚乙二醇
E. 羟苯乙酯

正确答案：B。液状石蜡

解析：本题考查非极性溶剂。液体石蜡（B对）为液体制剂中常用的非极性溶剂；苯扎溴铵（A错）具有典型阳离子表面活性剂的性质；苯甲酸（C错）一般常作为药物或防腐剂使用，有抑菌的作用；聚乙二醇（D错）是非离子型的水溶性聚合物，它能与许多极性较高的物质配伍，用途广泛；羟苯乙酯（E错）是液体制剂中常用的防腐剂。